属于阴阳两虚的是
A. 阳胜则阴病
B. 阳损及阴
C. 二者均是
D. 二者均非

正确答案：B。阳损及阴

解析：本题考查的是阴阳互损的内容。属于阴阳两虚的是阳损及阴（B对）。阳损及阴，是指由于阳气虚损，无阳则阴无以生，从而在阳虚的基础上又导致了阴虚，形成以阳虚为主的阴阳两虚的病机变化。“阳胜则阴病”，即阳盛则阴虚。但从病机上必须区分阴的虚损程度。邪客于阳而致阳盛，此时由于阴的相对不足，从而出现实热证。如果由于阳盛而耗伤机体的阴液，此时阴由相对的不足转而成为绝对的虚亏，这就从实热证转化为虚热证或实热兼阴亏证。